黄体酮混悬型长效注射剂给药途径是
A. 皮内注射
B. 皮下注射
C. 静脉注射
D. 动脉注射
E. 椎管内注射

正确答案：B。皮下注射

解析：本题考查黄体酮混悬型长效注射剂给药途径。黄体酮混悬型长效注射剂给药途径是皮下注射（B对）。黄体酮是由卵巢黄体分泌的一种天然孕激素，是维持妊娠的重要激素。黄体酮混悬型长效注射剂，通过肌内或皮下注射给药，临床主药用于治疗先兆性流产及辅助生殖黄体支持。皮内注射（A错）是将药物注射到真皮中，此部位血管稀且小，吸收差，只用于诊断与过敏试验，注射量在0.2ml以内。动脉内注射（D错）将药物或诊断药直接输入靶组织或器官。如抗肿瘤药经动脉作区域性滴注，用于肿瘤治疗，可提高疗效和降低毒性。混悬型注射剂是将不溶性的固体药物以微粒状态分散于液体介质中制成的一类供肌注的一类药剂。混悬型注射液不得用于静脉注射（C错）或椎管内注射（E错）。